患者因龋坏牙充填后5年出现冷热痛，偶有自发钝痛。查：左上6近中邻（牙合）面充填体，颊测龈壁可探入，发黑，叩诊（±）冷热测疼痛。其原因为
A. 充填物早接触
B. 充填时没垫底
C. 继发龋
D. 备洞时操作不当
E. 充填体的化学性刺激

正确答案：C。继发龋

解析：患者因龋坏牙充填后5年出现冷热痛，偶有自发钝痛。查：左上6近中邻（牙合）面充填体，颊测龈壁可探入，发黑，叩诊（±）冷热测疼痛。其原因为继发龋（C对）。根据病例描述，患牙充填5年后，出现冷热痛，偶有自发钝痛，表明牙髓有慢性炎症；检查见左上6近中邻（牙合）面充填体，颊测龈壁可探入，发黑，可知患牙有继发龋，龋病继续发展累及牙髓出现牙髓炎症。充填物早接触主要表现为充填后出现咀嚼性疼痛，与温度刺激无关（A错）。充填时没垫底，温度刺激可通过充填体刺激牙髓，短期内出现牙髓激惹症状（B错）。备洞时操作不当可导致意外穿髓，在短期内即可出现明显的症状（D错）。充填体的化学性刺激可导致牙髓逐渐发炎，症状会在充填一段时间之后逐渐出现，并逐渐加重（E错）。